正常菌群在人体的分布呈现动态的平衡状态，称为
A. 正常菌群
B. 微生态平衡
C. 机会致病菌
D. 菌群失调
E. 菌群失调症

正确答案：B。微生态平衡

解析：正常菌群在人体的分布呈现动态的平衡状态，称为微生态平衡。掌握“细菌的分类”知识点。